以下哪项的操作内容为“仅去除窝沟处的病变釉质或牙本质，根据龋损的大小，采用酸蚀技术和树脂材料充填龋洞并在牙面上涂一层封闭剂,防止龋病进展”
A. 预防性树脂充填
B. 非创伤性修复
C. 点隙裂沟封闭
D. 烤瓷熔附金属全冠修复
E. 嵌体预备

正确答案：A。预防性树脂充填

解析：预防性树脂充填方法仅去除窝沟处的病变釉质或牙本质，根据龋损的大小，采用酸蚀技术和树脂材料充填龋洞并在牙面上涂一层封闭剂，这是一种窝沟封闭与窝沟龋充填相结合的预防性措施。掌握“预防性树脂充填”知识点。